汞的主要蓄积部位是
A. 骨骼
B. 肾脏
C. 肝脏
D. 骨髓
E. 神经组织

正确答案：B。肾脏

解析：汞进入体内的初期在各组织分布大致平衡，组织中的含量仅与该组织的血流量有关，数小时后开始向肾脏（B对）集中，主要分布于肾皮质中。